暴发型流脑休克型迅速出现大片瘀斑，血小板减少，顽固性休克时，除抗休克外，其重要对症治疗是
A. 止血
B. 纠正酸中毒
C. 使用抗菌药物
D. 及早应用肝素抗凝治疗
E. 20%甘露醇脱水，预防脑疝

正确答案：D。及早应用肝素抗凝治疗

解析：暴发型流脑休克型迅速出现大片瘀斑，血小板减少，顽固性休克时，除抗休克外，应及早应用肝素抗凝治疗（D对）。应用肝素时，应监测凝血时间，维持在正常值的2.5～3倍为宜。多数应用1～2次见效而停用。高凝状态纠正后，应输入新鲜血液、血浆及维生素K，以补充被消耗的凝血因子。